黄疸胆腑郁热的主治方剂是
A. 小柴胡汤
B. 大柴胡汤
C. 葛根芩连汤
D. 升麻葛根汤
E. 龙胆泻肝汤

正确答案：B。大柴胡汤

解析：胆腑郁热证之黄疸为湿热砂石郁滞，脾胃不和，肝胆失疏所致，治宜疏肝泄热，利胆退黄，方用大柴胡汤（B对）。小柴胡汤适用于伤寒少阳证，妇人伤寒，热入血室，以及疟疾、黄疸与内伤杂病而见少阳证者（A错）。葛根芩连汤适用于湿热所致的腹泻和痢疾（C错）。升麻葛根汤适用于麻疹初起（D错）。龙胆泻肝汤适用于肝胆实火上扰证（E错）。